属于“Ⅱ”类切口的手术是
A. 小肠切除吻合术
B. 化脓性阑尾炎手术
C. 腹腔镜疝修补术
D. 结肠脾曲癌引起的急症肠梗阻手术
E. 胃后壁穿孔手术

正确答案：E。胃后壁穿孔手术

解析：手术切口分为三类：Ⅰ类切口（清洁切口）是指缝合的无菌切口，如甲状腺大部切除术、腹腔镜疝修补术（C错）等。Ⅱ类切口（清洁-污染切口）是指手术时可能带有污染的缝合切口，如胃大部切除术、胃后壁穿孔手术（E对）。Ⅲ类切口（污染切口）是指邻近感染区域或组织直接暴露于污染或感染物的切口，如小肠切除吻合术（A错）、化脓性阑尾炎手术（B错）、结肠脾曲癌引起的急症肠梗阻手术（D错）等。